舌下含片给药属于哪种途径
A. 注射给药剂型
B. 呼吸道给药剂型
C. 皮肤给药剂型
D. 黏膜给药剂型
E. 腔道给药剂型

正确答案：D。黏膜给药剂型

解析：本题考查给药途径。舌下含片经舌下黏膜吸收从而发挥全身作用，属于黏膜给药剂型（D对）；注射给药剂型（A错）通过注射将药物送至相应部位；皮肤给药剂型（C错）是通过涂抹于皮肤或与皮肤直接接触发挥作用；呼吸道给药剂型（B错）是通过呼吸道进入体内发挥作用；腔道给药剂型（E错）是通过腔道给药发挥作用。